急性低张性缺氧时机体最重要的代偿机制是：
A. 心率加快
B. 心肌收缩性增强
C. 肺通气量增加
D. 脑血流量增加
E. 腹腔内脏血流量减少

正确答案：C。肺通气量增加

解析：急性低张性缺氧时最重要的代偿反应是低氧通气反应，即Pa02降低可刺激颈动脉体和主动脉体化学感受器，反射性兴奋呼吸中枢，使呼吸加深加快，肺通气量增加（C对）。心率加快（A错）、心肌收缩性增强（B错）、脑血流量增加（D错）和腹腔内脏血流量减少（E错）虽然也是缺氧时的代偿反应，但不是急性缺氧时最重要的代偿机制。